小儿感冒容易出现兼证，多见
A. 挟火挟痰挟湿
B. 挟火挟痰挟滞
C. 挟风挟痰挟滞
D. 挟惊挟痰挟滞
E. 挟湿挟惊挟滞

正确答案：D。挟惊挟痰挟滞

解析：由于小儿肺脏娇嫩，感邪之后，肺气失宣，气机不利，津液不得敷布而内生痰液，痰壅气道，则咳嗽加剧，喉间痰鸣，此为感冒夹痰；小儿脾常不足，感邪之后，脾运失司，稍有饮食不节，致乳食停滞，阻滞中焦，则脘腹胀满，不思乳食，或伴呕吐、泄泻，此为感冒夹滞；小儿神气怯弱，感邪之后，热扰心肝易致心神不宁，睡卧不实，惊惕抽搐，此为感冒夹惊（D对）。